大多数原核生物基因转录调控机制是
A. 操纵子
B. 启动子
C. 增强子
D. 沉默子
E. 衰减子

正确答案：A。操纵子